女性，62岁。高血压患者，突然心悸、气促，咳粉红色泡沫痰。查体:血压200/126mmHg，心率146次/分。除其他治疗外，还应选用下列药物中的
A. 毛花苷C、硝酸甘油、异丙肾上腺素
B. 毒毛花苷K、硝普钠、普萘洛尔
C. 胍乙啶、酚妥拉明、毛花苷C
D. 硝普钠、毛花苷C、呋塞米
E. 硝酸甘油、毛花苷C、多巴胺

正确答案：D。硝普钠、毛花苷C、呋塞米

解析：严重高血压导致急性心衰肺水肿发作时，降压、扩张动静脉、强心、利尿是较好的治疗方案。掌握“心力衰竭”知识点。